急性呼吸窘迫综合征最重要的临床特征是
A. 双肺渗出性病变
B. 呼吸困难和体位无关
C. 呼吸频率显著增加
D. 顽固性低氧血症
E. 混合型呼吸困难

正确答案：D。顽固性低氧血症

解析：急性呼吸窘迫综合症（ARDS）的肺形态改变有两个特点，一是肺水肿和肺不张在肺内呈不均一分布，二是肺水肿和肺泡萎陷，使功能残气量和有效参与气体交换的肺泡数量减少，这些可引起严重通气/血流比例失调、肺内分流和弥散障碍，造成顽固性低氧血症，且不能被普通的吸氧方法所纠正，故最重要的临床特征是顽固性低氧血症（D对）。双肺渗出性病变（A错）、呼吸困难和体位无关（B错）、呼吸频率显著增加（C错）、混合型呼吸困难（E错）均无特异性，普通肺炎即可有这些症状。